治疗癫痫持续状态，首选的药物是
A. 注射用丙戊酸钠
B. 卡马西平片
C. 苯巴比妥片
D. 苯妥英钠片
E. 地西泮注射液

正确答案：E。地西泮注射液

解析：本题考查抗癫痫药。地西泮注射液（E对）为癫痫持续状态的首选药。丙戊酸钠（A错）是治疗癫痫失神发作、原发性全面性发作、强直阵挛发作、肌阵挛强直、失张力发作、部分性发作的首选药。卡马西平（B错）用于治疗癫痫、躁狂症、三叉神经痛。苯巴比妥（C错）用于强直-阵挛性发作、部分发作及新生儿癫痫。苯妥英钠（D错）用于治疗强直阵挛性发作（精神运动性发作）。